蛋白质-能量营养不良患儿最先出现的表现是
A. 体重不增
B. 水肿
C. 体重减轻
D. 身高低于正常
E. 皮下脂肪消失

正确答案：A。体重不增

解析：由于各种原因引起的蛋白质和（或）热能摄入不足或消耗增多引起的营养缺乏病，又称蛋白质-能量营养不良。营养不良的早期表现为活动减少，精神较差，体重生长速度不增（A对）。随营养不良加重，体重逐渐下降（C错）、皮下脂肪消耗（E错）、身高亦低于正常（D错）等。血浆白蛋白明显下降时出现凹陷性水肿（B错）。